薄荷的功效是
A. 止痉
B. 平肝
C. 通鼻窍
D. 清利头目
E. 清肺润燥

正确答案：D。清利头目

解析：本题考查的是薄荷的功效。薄荷的功效是清利头目（D对）。薄荷：【功效】宣散风热，清利头目，利咽，透疹，疏肝。蝉蜕：【功效】疏散风热，透疹止痒，明目退翳，息风止痉（A错）。桑叶：【功效】疏散风热，清肺润燥（E错），平肝（B错）明目，凉血止血。苍耳子：【功效】散风寒，通鼻窍（C错），除湿止痛，止痒。